6岁以上学龄儿童应
A. 无需刷牙
B. 有条件即刷牙
C. 每天至少刷三次牙
D. 每天早上至少刷一次牙
E. 在家长的督促下每天早晚刷牙

正确答案：E。在家长的督促下每天早晚刷牙

解析：本题考查学龄儿童口腔保健。6岁以上学龄儿童应在家长的督促下每天早晚刷牙（E对）。